可复性盘前移位、不可复性盘前移位属于
A. 咀嚼肌紊乱疾病类
B. 关节结构紊乱疾病类
C. 炎性疾病类
D. 骨关节疾病类
E. 骨关节炎

正确答案：B。关节结构紊乱疾病类

解析：关节结构紊乱疾病类是关节紊乱病中构成比最高的一类。此类疾病常见类型包括可复性盘前移位、不可复性盘前移位、关节囊扩张伴关节盘附着松弛。掌握“颞下颌关节紊乱”知识点。